某地的一项关于膀胱癌与吸烟关系的大规模研究得出，吸烟者膀胱癌的发病率为50/10万，非吸烟者的膀胱癌的发病率为25/10万，根据以上资料，因吸烟所致的超额危险度（即特异危险度）为
A. 6/10万
B. 8/10万
C. 25/10万
D. 32/10万
E. 0.5/10万

正确答案：C。25/10万

解析：本题考查特异危险度的计算。特异危险度是暴露组发病率与对照组发病率相差的绝对值。题中特异危险度＝50/10万－25/10万＝25/10万（C对ABDE错）。